对所有疑似霍乱的病人需要采集的标本是
A. 尿
B. 血液
C. 大便
D. 痰
E. 脓液

正确答案：C。大便